多数中老年人认为合理饮食、参加体育运动很有必要，就是不知道如何合理营养、运动没有场所，则应
A. 重点考虑倾向因素
B. 重点考虑促成因素
C. 重点考虑强化因素
D. 其他因素
E. 以上都不对

正确答案：C。重点考虑强化因素